药历的主要内容有
A. 患者的基本情况
B. 药学监护计划
C. 联合用药情况
D. 非药物治疗情况
E. 药物治疗的成本计算

正确答案：A、B、C、D。患者的基本情况；药学监护计划；联合用药情况；非药物治疗情况

解析：本题考查的是药历的主要内容。药历的主要内容有患者的基本情况（A对）、药学监护计划（B对）、联合用药情况（C对）、非药物治疗情况（D对）。药历的主要内容有患者的基本情况、药学监护计划、联合用药情况、非药物治疗情况。